男孩，5岁。发热、盗汗，食欲减退5天。伴喷射性呕吐5小时，入院后经治疗无效死亡，尸检可见蛛网膜下腔黄色浑浊的胶冻样渗出物，以颅底部明显，并见多个粟粒样灰白色结节，镜下可见肉芽肿样病变。最可能的疾病是
A. 脑囊虫病
B. 化脓性脑膜炎
C. 多发性脑脓肿
D. 乙型脑炎
E. 结核性脑膜炎

正确答案：E。结核性脑膜炎

解析：患儿发热、盗汗，食欲减退（典型结核中毒症状），喷射性呕吐（提示脑膜刺激征），尸检可见蛛网膜下腔黄色浑浊的胶冻样渗出物，以颅底部明显，并见多个粟粒样灰白色结节，镜下可见肉芽肿样病变。最可能的疾病是结核性脑膜炎（E对）。化脓性脑膜炎（B错）多见于冬春季，大多有皮肤、黏膜瘀点，脑脊液脓样。乙型脑炎（D错）多见于夏秋季，多脑实质损害，脑脊液清亮或微混。脑囊虫病（A错）在有吃生猪肉习惯的地区或民族中甚为流行，有疫区接触史，潜伏期较长，临床表现轻重不一 ，复杂多变，主要表现为颅内压增高、局灶神经体征、癫痛、精神障碍等非脑膜刺激症状。